有关暴露组学，说法不正确的是
A. 关注从受孕开始的终生暴露全过程
B. 职业生涯中不同时期暴露有因素的总体
C. 采用全暴露组关联研究方法
D. 检测所有可能的暴露标志
E. 暴露组学依赖于基因组学、蛋白质组学等的发展

正确答案：B。职业生涯中不同时期暴露有因素的总体

解析：本题考查暴露组学的相关内容。暴露组学重点关注从妊娠（受精卵）开始贯穿于人一生整个生命周期的环境暴露全过程（A对），采用全暴露组关联研究方法（C对），检测所有可能的暴露标志（D对），再重复验证，确定有效的生物标志，进而利用此等生物标志来阐明暴露-效应关系、作用机制等。暴露组学关注个体一生中所暴露的测量及此等暴露与疾病之间的联系，它依赖于基因组学、蛋白质组学、脂类组学、糖组学、转录组学、代谢组学、加合物组学等的发展（E对），以全面揭示暴露与疾病之间的关系。职业生涯中不同时期暴露有因素的总体(B错，为本题正确答案)是错误的。